淋病的特点，错误的是
A. 易侵袭黏膜
B. 以性传播为主
C. 是世界上发病率最高的性传播疾病
D. 感染最早期表现为阴道炎
E. 病原体为革兰阴性双球菌

正确答案：D。感染最早期表现为阴道炎

解析：淋病是由淋菌引起的以泌尿生殖系统化脓性感染为主要表现的疾病，以性传播为主（B对），是世界上发病率最高的性传播疾病（C对）。淋菌为革兰阴性双球菌（E对），对柱状上皮及移行上皮黏膜有亲和力，易侵袭黏膜（A对），感染最早期表现为宫颈炎（D错，为本题正确答案）。